以碳酸氢钠和有机酸为主要辅料制备的颗粒剂是
A. 可溶性颗粒
B. 混悬颗粒
C. 泡腾颗粒
D. 肠溶颗粒
E. 控释颗粒

正确答案：C。泡腾颗粒

解析：本题考查颗粒剂。泡腾颗粒（C对）是以碳酸氢钠和有机酸为主要辅料制备的颗粒剂，能够在水中呈现出泡腾状；可溶性颗粒（A错）具有普通颗粒剂的性质；混悬颗粒（B错）是指难溶性固体药物与适宜辅料制成一定粒度的干燥颗粒剂；肠溶颗粒（D错）系指采用肠溶材料包裹材料制成的颗粒，耐胃酸；控释颗粒（E错）系指在规定的释放介质中缓慢地恒速释放药物的颗粒制剂。